属于Ⅱ型超敏反应的疾病是
A. 血小板减少性紫癜
B. 血清病
C. SLE
D. 过敏性鼻炎
E. 荨麻疹

正确答案：A。血小板减少性紫癜